女性，18岁。上前牙两牙之间有点状发黑。无自发痛和冷、热刺激痛。口腔检查：左右上1近中邻面点状黑斑，表面粗糙，叩诊（-），探诊（-）。最可能的诊断是
A. 浅龋
B. 中龋
C. 深龋
D. 静止龋
E. 继发龋

正确答案：A。浅龋

解析：本题考查浅龋。女性，18岁。上前牙两牙之间有点状发黑。无自发痛和冷、热刺激痛。口腔检查：左右上1近中邻面点状黑斑，表面粗糙，叩诊（-），探诊（-）。最可能的诊断是浅龋（A对）。浅龋位于釉质内，患者一般无主观症状，无自发痛，遇外界物理和化学刺激无明显反应。中龋时患者对酸甜饮食敏感，过冷过热饮食能产生痛觉（B错）。深龋时食物入洞疼痛，遇冷热和化学刺激产生的疼痛更剧烈（C错）。静止龋病变停止，病变环境发生改变，隐蔽部位变得开放，损害保持原状（D错）。继发龋可能为充填物边缘或窝洞周围牙体组织破裂或修复材料与牙体组织不密合，产生龋病，患牙未见充填材料（E错）。